可稀释痰液，并借助咳嗽反射帮助痰液排出，避免堵塞气道的药品是
A. 布地奈德
B. 扎鲁司特
C. 沙丁胺醇
D. 羧甲司坦
E. 多索茶碱

正确答案：D。羧甲司坦

解析：本题考查羧甲司坦。可稀释痰液，并借助咳嗽反射帮助痰液排出，避免堵塞气道的药品是羧甲司坦（D对）。羧甲司坦为黏液调节剂，主要调节支气管腺体分泌，增加低黏度的唾液黏蛋白分泌，减少高黏度的岩藻黏蛋白产生，使痰液黏滞性降低，易于咳出；也能加强呼吸道纤毛运动，促进痰液排出。布地奈德（A错）、扎鲁司特（B错）、沙丁胺醇（C错）、多索茶碱（E错）均为平喘药。